本身并非糖皮质激素，但可致肾病综合征的药物是
A. 氟轻松
B. 布洛芬
C. 曲安奈德
D. 布地奈德
E. 倍氯米松

正确答案：B。布洛芬

解析：本题考查布洛芬。本身并非糖皮质激素，但可致肾病综合征的药物是布洛芬（B对）。肾功能明显障碍的患者使用布洛芬有发生急性肾衰竭的报道，故肾功能不全者应慎用。氟轻松（A错）、曲安奈德（C错）、布地奈德（D错）、倍氯米松（E错）均为糖皮质激素类药物。